男性，40岁，体健，吸烟：40支/日。临床诊断为慢性牙周炎，经牙周系统治疗及局部药物治疗后效果不理想，口腔卫生状况尚可。应最先考虑影响其疗效的因素是
A. 营养因素
B. 咬合关系
C. 吸烟
D. 使用的药物不当
E. 工作紧张

正确答案：C。吸烟

解析：本题考查不良习惯对慢性牙周炎疗效的影响。患者男，40岁，体健（无营养不良），吸烟：40支/日（大量吸烟）。临床诊断为慢性牙周炎，经牙周系统治疗及局部药物治疗后效果不理想，口腔卫生状况尚可。上述情况，应最先考虑影响其疗效的因素是吸烟（C对）。营养因素（A错）、咬合关系（B错）、使用的药物不当（D错）、工作紧张（E错），均未见患者有相关情况。